外用药品
A. 标签上应注明质量标准
B. 标签上应有《中国人民共和国药品管理法实施办法》中规定的标志
C. 两者均需要
D. 两者均不需要

正确答案：C。两者均需要

解析：本题考查药品标准。外用药品标签上应注明质量标准，标签上应有《中国人民共和国药品管理法实施办法》中规定的标志（C对）。药品标准也称药品质量标准，是指对药品的质量指标、生产工艺和检验方法等所作的技术要求和规范，内容包括药品的名称、成分或处方的组成；含量及其检验方法；制剂的辅料规格；允许的杂质及其限量；以及药品的作用、用法、用量；注意事项；贮藏方法等。《药品管理法》中规定药品的外标签应当注明药品通用名称、成分、性状、适应症或者功能主治、规格、用法用量、不良反应等，即标签上需要注明质量标准。精神药品与麻醉药品、毒性药品等均需标有《中国人民共和国药品管理法实施办法》中规定的标志。